在我国，就社区卫生服务而言，社区一般界定为城市的和农村的
A. 居委会，村
B. 居委会，乡镇
C. 居委会，县
D. 街道，村
E. 街道，乡镇

正确答案：E。街道，乡镇